静注某单室模型药物，每10小时给药一次，已知该药V=10L，Xo=500mg，k=0.1h-1，其平均稳态血药浓度是
A. 5mg/L
B. 50mg/L
C. 500mg/L
D. 5000mg/L
E. 50000mg/L

正确答案：B。50mg/L